常用于空气或物体表面
A. 滤过除菌法
B. 干烤法
C. 紫外线照射法
D. 巴氏消毒法
E. 高压蒸汽灭菌法

正确答案：C。紫外线照射法

解析：本题考查消毒与灭菌。常用于空气或物体表面的消毒方法为紫外线照射法（C对）。过滤除菌法（A错）是用物理阻留的方法将液体或空气的细菌除去，以达到无菌目的。 所用的器具是含有微小孔径的滤菌器。 主要用于血清、毒素、抗生素等不耐热生物制品及空气的除菌。干烤法（B错）为消毒灭菌的一种，利用特制的烤箱，热力通过空气对流和介质传导进行灭菌，效果可靠。 用于油剂、粉剂、玻璃器皿、金属制品、陶瓷制品等在高温下不变质、不损坏、不蒸发的物品。巴氏消毒法（D错）是用60～90℃的短暂加热，来杀死液体中的微生物，以达到保质的效果。确切温度和时间依照液体的种类和它所含的微生物的性质而不同。现在主要用于牛奶、葡萄酒啤酒和果汁消毒。高压蒸汽灭菌法（E错）常用于细菌培养基的灭菌。